下列关于病因链与病因网络的论述，不正确的是
A. 病因网络由多个完全独立的病因链组成
B. 不同的病因链可能独立地影响疾病的发生
C. 去除一条病因链中的任何一个因素就可以完全切断整个病因链，从而预防疾病通过此病因链发生
D. 同时切断多条病因链可以预防更多的病例
E. 不同的病因链对疾病发生的作用的大小可能不同，有效的预防应切断主要的病因链

正确答案：A。病因网络由多个完全独立的病因链组成

解析：本题考查病因链与病因网。很少疾病只有一个单一的病因链，事实上一个疾病往往存在多个独立的或相互关联的病因链，同一疾病不同病因链相互连结、相互交错，形成一个更为复杂的完整的病因关系网（A错，为本题正确答案）。病因网的概念可以从理论上更清楚地解释疾病预防中的很多现象：1.去除一条病因链中的任何一个因素就可以完全切断整个病因链，从而预防疾病通过此病因链发生（C对），这使得阻断病因链有了多种选择，增加了预防的方法和可能性。2.不同的病因链对疾病发生的作用的大小可能不同，有效的预防应切断主要的病因链（E对）。3.不同的病因链可能独立地影响疾病的发生（B对），同时切断多个病因链必然可以预防更多的病例（D对）。